以下哪种情况属于医源性感染
A. 患者由于医院内场所消毒不严格所造成的医院感染
B. 入院时处于某种传染性疾病潜伏期的患者在入院后发病导致的医院感染
C. 医师与患者直接接触而导致的医院感染
D. 同一病房的患者通过间接接触导致的医院感染
E. 长期使用免疫抑制剂的患者体内的正常菌群成为条件致病菌导致的感染

正确答案：A。患者由于医院内场所消毒不严格所造成的医院感染